入睡则汗出，醒则汗止的为
A. 自汗
B. 盗汗
C. 绝汗
D. 战汗
E. 头汗

正确答案：B。盗汗

解析：盗汗指睡时汗出，醒则汗止的症状（B对）。自汗指醒时经常汗出，活动后尤甚的症状（A错）。绝汗指在病情危重的情况下，出现大汗不止的症状（C错）。战汗指患者先恶寒战栗而后汗出的症状（D错）。头汗又称但头汗出，指汗出仅见于头部，或头颈部汗出量多的症状（E错）。